大气质量玫瑰图包含了
A. 比值算术均数型大气质量指数
B. 分线段函数型大气质量指数
C. 幂函数型环境质量指数
D. 大气质量预报
E. 空气质量预报

正确答案：B。分线段函数型大气质量指数

解析：本题考查大气质量玫瑰图的指数。大气质量玫瑰图包含了分线段函数型大气质量指数（B对ACDE错）。这类指数的各分指数与其实测浓度呈分段线性函数关系，指数的表示也以各分指数分别表示或选择最高的表示，并赋予其健康效应含义和应采取的措施。